中华人民共和国卫生部颁布《医务人员医德规范及实施办法》的时间是
A. 1988年10月15日
B. 1988年12月15日
C. 1949年10月15日
D. 1949年12月15日
E. 1978年12月15日

正确答案：B。1988年12月15日